引起新生儿化脓性脑膜炎最常见的致病菌是
A. 肺炎链球菌
B. 流感嗜血杆菌
C. 大肠埃希菌
D. 金黄色葡萄球菌
E. 隐球菌

正确答案：C。大肠埃希菌

解析：因为新生儿免疫防御功能低下，肠道革兰阴性杆菌和金黄色葡萄球菌（D错）易通过上呼吸道、皮肤、胃肠粘膜或脐部侵入血液，引起新生儿化脓性脑膜炎，其中以大肠埃希菌最常见（C对）。肺炎链球菌（A错）引起的化脓性脑膜炎见于年长儿。流感嗜血杆菌（P403）（B错）引起的化脓性脑膜炎多见于2个月至2岁儿童。隐球菌（P404）（E错）属真菌类，不引起化脓性脑膜炎。